HBV感染的高危人群不包括
A. 老年人群
B. 血液透析患者
C. 医务工作者
D. 静脉内注射吸毒者
E. 同性恋人群

正确答案：A。老年人群